巴氏消毒法属于
A. 热力消毒
B. 辐射消毒
C. 过滤消毒
D. 化学消毒
E. 生物消毒

正确答案：A。热力消毒

解析：消毒方法有物理消毒法、化学消毒法和生物消毒法。巴氏消毒法属于物理消毒法中的热力消毒法（A对）。